铁、锌属于
A. 植物化学物
B. 宏量营养素
C. 微量元素
D. 宏量元素
E. 抗氧化营养素

正确答案：C。微量元素